主要用于控制疟疾症状的药物是
A. 氯喹
B. 甲硝唑
C. 乙胺嘧啶
D. 吡喹酮
E. 伯氨喹

正确答案：A。氯喹

解析：本题考查常用抗疟药及其分类。主要用于控制症状的抗疟药有氯喹（A对）、奎宁、青蒿素。甲硝唑（B错）为抗阿米巴病药。乙胺嘧啶（C错）为主要用于预防的抗疟药。吡喹酮（D错）为抗血吸虫病药。伯氨喹（E错）为主要用于控制复发和传播的抗疟药。